克伦特罗的作用是
A. 抑制咳嗽的冲动传入
B. 抑制咳嗽中枢
C. 稳定肥大细胞膜
D. 激动气管β受体
E. 溶解气饯内黏液

正确答案：D。激动气管β受体